男，40岁。肝区疼痛3个月，无发热。右肋下触及肝脏，质硬，表面有直径5cm结节，无触痛。既往慢性乙型病毒性肝炎病史10年。为确认诊断最有意义的检查是
A. 腹部CT
B. 穿刺活检
C. 选择性肝动脉造影
D. 腹部B超
E. 腹部MRI

正确答案：B。穿刺活检

解析：中年患者，10年乙肝病史，肝区疼痛，肝大质硬有结节，结合病史及临床表现，考虑为原发性肝癌。穿刺活检（B对）可直接观察细胞、组织病变，具有确诊意义。腹部CT（A错）和MRI（E错）对肝脏恶性病变诊断价值相仿，可明确病变部位大小，但无法确诊。选择性肝动脉造影（C错）准确率比CT或MRI更高，但是是创伤性检查，会给病人带来一定痛苦甚至并发症。B超（D错）是性价比较高的无创性检查，可作为肝癌的筛查手段。